女性，46岁。血性白带半年就诊。检查见阴道左穹隆消失，宫颈重度糜烂，子宫正常大小，右侧附件浸润未达盆壁，宫颈活检为鳞状细胞癌。为进一步确诊，最有诊断价值的辅助检查方法应为
A. B超检查
B. 胸部X线检查
C. 分段刮宫合并病理检查
D. 肿瘤标记物检查
E. 腹腔镜检查

正确答案：C。分段刮宫合并病理检查

解析：病理检查能确诊子宫颈癌，是诊断子宫颈癌的金标准，因此分段刮宫合并病理检查（C对）最有诊断价值。确诊后，可选择B超检查（A错）、胸部X线检查（B错）、腹腔镜检查（E错）观察肿瘤转移情况，但诊断价值不大。肿瘤标记物检查（D错）不具有特异性，诊断价值不大。